在体内被脱氨酶迅速脱氨，生成无活性代谢物的药物是
A. 卡莫司汀
B. 氟尿嘧啶
C. 环磷酰胺
D. 巯嘌呤
E. 盐酸阿糖胞苷

正确答案：E。盐酸阿糖胞苷